药物的光敏性是指药物被光降解的敏感程度。下列药物中光敏性最强的是
A. 氯丙嗪
B. 硝普钠
C. 维生素B₂
D. 叶酸
E. 氢化可的松

正确答案：B。硝普钠

解析：本题考查光敏性。光敏性最强的是硝普钠（B对）。常见的对光敏感的药物有：硝普钠、氯丙嗪、异丙嗪、维生素B₂、氢化可的松、泼尼松、叶酸、维生素A、维生素B₁、辅酶Q10、硝苯地平等。其中硝普钠对光极不稳定，临床上用5%的葡萄糖配制成0.05%的硝普钠溶液静脉滴注，在阳光下照射10分钟就分解13.5%，颜色也开始变化，同时pH下降。室内光线条件下，本品半衰期为4小时。氯丙嗪（A错）、维生素B₂（C错）、叶酸（D错）、氢化可的松（E错）均对光敏感，但不是光敏性最强的药物。